心室肌细胞有效不应期特别长的生理意义是
A. 心房和心室可以同步
B. 有利于心房兴奋
C. 有利于心室肌休息
D. 使心室肌细胞不会发生强直收缩
E. 有助于室间隔兴奋

正确答案：D。使心室肌细胞不会发生强直收缩

解析：心室肌细胞有效不应期特别长的生理意义是使心室肌细胞不会发生强直收缩（D对BCE错），有效不应期一直延续到舒张早期，在此期间心肌不再接受任何细胞刺激而产生兴奋和收缩，所以不会发生完全强直收缩，从而保证心脏泵血活动的正常进行。心肌细胞之间有低电阻的闰盘存在使心房和心室可以同步（A错），因此，心肌可看做是一个功能合胞体。